测量卫生服务利用的常用指标有
A. 两周患病率
B. 慢性病患病率
C. 两周患者就诊率
D. 两周患病天数

正确答案：C。两周患者就诊率

解析：本题考查测量卫生服务利用的常用指标。两周患者就诊率（C对ABD错）是测量卫生服务利用的常用指标。两周患者就诊率＝调查前两周内患者就诊人（次）数/两周患者总例数×l00%。